婴幼儿哮喘最基本的治疗方法是应用
A. 局部糖皮质激素
B. 全身糖皮质激素
C. β2肾上腺素能受体激动剂
D. 茶碱类药物
E. 细胞膜稳定剂

正确答案：A。局部糖皮质激素

解析：糖皮质激素是目前最有效的抗炎药物，通过吸入糖皮质激素疗法直接作用于气道黏膜局部，不仅可以使局部抗炎作用加强，同时还可以使全身的不良反应减少，所以婴幼儿哮喘最基本的治疗方法是应用局部糖皮质激素（A对）。全身糖皮质激素仅用于非常严重的婴幼儿哮喘，不是基本的治疗方法（B错）。β2肾上腺素能受体激动剂一般用于急性发作的婴幼儿哮喘（C错）。茶碱类药物是哮喘急性发作治疗的一部分，不单独应用治疗哮喘，所以茶碱类药物并不是婴幼儿哮喘基本的治疗方法（D错）。膜稳定剂仅用于预防运动及其他刺激诱发的哮喘（E错）。